男，47岁。HBsAg阳性20年，乏力、纳差、尿黄7天。查体：巩膜黄染，肝肋下2cm，质软。实验室检查：ALT460U/L，TBil84umol/L，HBVDNA1.2×10⁵/ml，抗HAVIgM（-），抗HEV（-），抗HCV（-）。最重要的治疗药物是
A. 核苷（酸）类似物
B. 护肝药物
C. 退黄药物
D. 干扰素
E. 利巴韦林

正确答案：A。核苷（酸）类似物

解析：中年男性患者，HBsAg阳性20年（慢性肝炎病史，肝硬化的高危人群），乏力、纳差、尿黄7天、巩膜黄染（肝功能减退的表现）。查体：肝肋下2cm（肝大）。实验室检查：ALT460U/L，TBil84umol/L，HBVDNA1.2×10⁵/ml（阳性，提示抗HBV治疗），抗HAVIgM（-），抗HEV（-），抗HCV（-）。根据患者的症状、体查及实验室检查可诊断为肝硬化。首选抗病毒治疗，最重要的治疗药物是核苷（酸）类似物（A对），以改善肝功能并延缓或减少肝移植的需求。护肝药物（B错）缺乏循证医学证据，过多使用加重肝负担。退黄药物（C错）可以改善胆汁淤积，为辅助用药。干扰素（D错）适用于肝硬化代偿期患者。利巴韦林（E错）适用于丙型肝炎患者抗病毒治疗。